引起人类沙眼的微生物是
A. 沙眼衣原体
B. 沙眼支原体
C. 细菌
D. 真菌
E. 病毒

正确答案：A。沙眼衣原体

解析：人类是沙眼衣原体的主要自然宿主。掌握“衣原体”知识点。